患者，男，23岁，因寒战、高热入院，诊断为感染性心内膜炎，血培养结果为草绿色链球菌，静脉滴注青毒素钠。根据《中华人民共和国药典临床用药须知》规定，用药前应进行皮肤过敏试验，青毒素皮试液的浓度是
A. 2000U/ml
B. 1000U/ml
C. 500U/ml
D. 200U/ml
E. 100U/ml

正确答案：C。500U/ml

解析：本题考查《中华人民共和国药典临床用药须知》中规定必须做皮肤敏感试验的常用药品药液浓度。青霉素钠注射剂的皮试药液浓度为500U/ml（C对），皮试量为0.1ml。